生长素一天中的分泌高峰期在
A. 清晨
B. 中午
C. 下午
D. 晚间
E. 慢波睡眠

正确答案：E。慢波睡眠